龋病充填治疗时，外形设计正确的是
A. 外形线的总体观应为正方形或长方形
B. 外形的范围根据龋坏的范围而定
C. 切削时，应尽量避让沟窝
D. 外形不宜作预防性扩展
E. 窝洞的外形线不要求长度和宽度

正确答案：B。外形的范围根据龋坏的范围而定

解析：本题考查窝洞的外形设计。窝洞外形线的设计以病变为基础，外形的范围根据龋坏的范围而定（B对）。窝洞的外形可根据龋坏的范围预备成圆形、椭圆形、正方形及长方形等形状（A错）。在切削牙体组织时，外形线尽量避开牙尖和嵴等承受咬合力的部位，以防止外形线处因承受较大的咬合力而产生裂隙（C错）。若龋坏在患牙邻面，备洞时应扩展到自洁区，以防止继发龋的发生（D错）。窝洞的外形线应具备一定的长度和宽度，以保证充填体有足够的抗力（E错）。